止咳宜蜜炙，止呕宜生用的药是
A. 葶苈子
B. 百部
C. 桑白皮
D. 枇杷叶
E. 紫菀

正确答案：D。枇杷叶

解析：本题考查的是枇杷叶的用法用量。止咳宜蜜炙，止呕宜生用的药是枇杷叶（D对）。枇杷叶：【用法用量】内服：煎汤，6～10g；或入丸散。止咳宜蜜炙用，止呕宜生用。葶苈子（A错）：【用法用量】内服：煎汤，3～10g，布包；或入丸散。百部（B错）：【用法用量】内服：煎汤，5～9g；或入丸散。外用：适量，煎汤熏洗，或研末撒。久咳虚喘宜蜜炙用，杀虫灭虱宜生用。桑白皮（C错）：【用法用量】内服：煎汤，6～12g；或入丸散。泻肺平喘宜蜜炙用，利水消肿宜生用。紫菀（E错）：【用法用量】内服：煎汤，5～10g；或入丸散。外感暴咳宜生用，肺虚久咳宜蜜炙用。